下列影响药物作用的因素中，属于遗传因素的有
A. 种属差异
B. 种族差异
C. 遗传多态性
D. 特异质反应
E. 交叉耐受性

正确答案：A、B、C、D。种属差异；种族差异；遗传多态性；特异质反应

解析：本题考查影响药物的作用因素。机体方面影响药物作用的遗传因素包括药物作用靶点、转运体和代谢酶的遗传多态性（C对），表现为种属差异（A对）、种族差异（B对）、个体差异和特异体质（D对）。交叉耐受性（E错）属于药物的性质。